影响地表水水质最主要因素是
A. 气候
B. 流量
C. 未处理生活污水、工业废水排入
D. 自然因素
E. 季节

正确答案：C。未处理生活污水、工业废水排入

解析：本题考查影响地表水水质最主要因素。地表水是降水在地表径流和汇集后形成的水体，包括江河水、湖泊水、水库水等。人类活动，特别是人为污染，是影响地表水水质的最主要因素，如未处理生活污水、工业废水排入（C对ABDE错）。